慢性支气管炎急性发作期最常见的表现是
A. 中性粒细胞增多
B. 嗜酸性粒细胞增多
C. 咳黏脓痰、咳嗽和痰量增多
D. 高热不退
E. 大咯血

正确答案：C。咳黏脓痰、咳嗽和痰量增多

解析：慢性支气管炎主要症状为咳嗽、咳痰，或伴有喘息，咳嗽一般以晨间咳嗽为主，睡眠时可见阵咳或排痰，痰多为白色浆液和浆液泡沫性。在急性呼吸道感染时，症状迅速加剧。痰量增多，粘稠度增加或为黄色脓性，偶有痰中带血，此为慢性支气管炎的急性发作（C对），急性期可见实验室检查中性粒细胞增多，嗜酸性粒细胞增多（B错），题干表述的是临床表现，选项与题干不符（A错）。在呼吸系统疾病中多见于哮喘。高热不退（D错）、大咯血（E错）在慢性支气管炎急性发作期少见。